手术前心理反应不包括
A. 对手术的恢复过程缺乏了解
B. 对手术安全性，尤其是麻醉缺乏了解
C. 术前心理准备不足，担心手术效
D. 对手术疼痛的恐惧
E. 过去的经验

正确答案：A。对手术的恢复过程缺乏了解

解析：手术前患者的心理反应最常见的是手术焦虑及相应的躯体反应。主要表现为对手术的担心和恐惧，躯体反应表现为心悸、胸闷、尿频、腹痛、腹泻及睡眠障碍等。主要原因包括：①对手术安全性，尤其是麻醉缺乏了解；②术前心理准备不足，担心手术效果；③对手术医生的年龄、技术、手术经验等反复思考，为此焦虑；④对手术疼痛的恐惧；⑤过去的经验，如既往住院及手术的经历，特别是伴有负性的情绪体验，或听说过某些手术意外的议论等。掌握“特殊患者心理”知识点。